大肠的主要生理功能是
A. 受盛
B. 传化糟粕
C. 化物
D. 泌别清浊
E. 通行元气

正确答案：B。传化糟粕

解析：受盛为小肠的生理功能（A错）。传化糟粕为大肠的生理功能（B对）。化物为小肠的生理功能（C错）。泌别清浊为小肠的生理功能（D错）。通行元气为三焦的生理功能（E错）。